25岁就诊患者，口腔卫生情况不佳，左下第一恒磨牙患者有牙髓-牙周联合病变，疼痛剧烈，但患牙无松动。为了消除病痛，恢复健康，首先采取的措施是开髓引流，阻止炎症扩展。上述治疗措施属于
A. 口腔健康教育
B. 特殊防护措施
C. 一级预防
D. 二级预防
E. 三级预防

正确答案：E。三级预防

解析：本题考查分级预防。为了消除病痛，恢复健康，首先采取的措施是开髓引流，阻止炎症扩展。此种治疗措施属于三级预防（E对）。开髓引流是对牙髓病和根尖周病的应急处理。口腔健康教育（A错）是对口腔保健知识和技术的传播，故开髓引流术不属于口腔健康教育。开髓引流属于治疗措施，而不是特殊防护措施（B错）。一级预防（C错）为病因学预防，开髓引流不属于一级预防。二级预防（D错）是早发现、早诊断、早治疗，提高治愈率，已发生牙髓病的患牙不属于二级预防。龋病的三级预防是对龋病所引起的根尖病和牙髓病进行处理，故开髓引流属于三级预防。